女，56岁，干咳、呼吸困难2周，逐渐加重，现不能平卧，无发热，查体：R24/分，BP85/70mmHg，端坐位，颈静脉怒张，双肺呼吸音清，心脏浊音界向两侧扩大，心率106次/分，律齐，心音遥远，心脏各瓣膜听诊区未闻及病理性杂音，奇脉，心电图，窦性心动过速，各导联QRS波低电压，该患者最关键的治疗方案是
A. 口服美托洛尔
B. 静脉滴注硝酸甘油
C. 静脉注射呋塞米
D. 静脉滴注多巴胺
E. 心包穿刺

正确答案：E。心包穿刺

解析：患者中年女性，干咳、呼吸困难2周，逐渐加重，现不能平卧（端坐呼吸），无发热（排除感染性心脏疾病），查体：R24/分（正常值12～20次/分），BP85/70mmHg（正常值90～120/60～90mmHg），端坐位，颈静脉怒张，双肺呼吸音清，心脏浊音界向两侧扩大，心率106次/分（正常值60～100次/分），律齐，心音遥远（心脏压塞典型临床表现），心脏各瓣膜听诊区未闻及病理性杂音，奇脉，心电图，窦性心动过速，各导联QRS波低电压（心包积液心电图表现）。综合患者体征，症状及心电图，考虑诊断为心包积液，最关键的治疗方案是心包穿刺（E对）。口服美托洛尔（A错）为β类阻滞剂，可用于降心律。静脉滴注硝酸甘油（B错）为扩管药，主要用于心绞痛。静脉注射呋塞米（C错）为利尿剂，减轻心源性水肿。静脉滴注多巴胺（D错）为正性肌力药，增加心肌收缩。